睾丸（卵巢）动脉的错误描述
A. 除起始部外，大部均与同名静脉伴行
B. 向外下行经输尿管后方
C. 起自主动脉腹部的前外侧壁
D. 睾丸动脉经深环穿行于腹股沟管
E. 卵巢动脉经卵巢悬韧带分布于卵巢

正确答案：B。向外下行经输尿管后方

解析：睾丸动脉沿腰大肌的前面斜向外下行，穿经腹股沟管（B错，为本题正确答案）入阴囊。起自主动脉腹部的前外侧壁（C对）。睾丸动脉经深环穿行于腹股沟管（D对）。卵巢动脉经卵巢悬韧带分布于卵巢（E对）和输卵管壶腹。